非处方药的特点有
A. 应用方便
B. 消费者可自行购买
C. 质量稳定
D. 说明书、标签简明易懂
E. 包装严密

正确答案：A、B、C、D、E。应用方便；消费者可自行购买；质量稳定；说明书、标签简明易懂；包装严密